某女，42岁。腹内出现肿块，固定不移，疼痛拒按，形体消瘦，纳谷减少，面色晦暗，肌肤甲错；舌暗紫，有瘀斑、瘀点，脉细涩。诊断为积聚，证属瘀血内结。可选用的中成药有
A. 康力欣胶囊
B. 肝脾康胶囊
C. 鳖甲煎丸
D. 和络舒肝胶囊
E. 化癥回生片

正确答案：C、E。鳖甲煎丸；化癥回生片

解析：本题考查的是积聚的辨证论治。腹内出现肿块，固定不移，疼痛拒按，形体消瘦，纳谷减少，面色晦暗，肌肤甲错；舌暗紫，有瘀斑、瘀点，脉细涩。诊断为积聚，证属瘀血内结。可选用的中成药有鳖甲煎丸（C对）与化癥回生片（E对）。积聚，又称“癥瘕”，是腹内结块，或痛或胀的疾病。（一）肝气郁结证：【中成药应用】常用中成药有逍遥丸、木香顺气丸、宽胸舒气化滞丸。（二）气滞血阻证：【中成药应用】常用中成药有中华肝灵胶囊、肝脾康胶囊（B错）、阿魏化痞膏。（三）瘀血内结证：【中成药应用】常用中成药有鳖甲煎丸、化癥回生片。（四）正虚邪结证：【中成药应用】常用中成药有和络疏肝胶囊（D错）、慢肝养阴胶囊。中成药应用为康力欣胶囊（A错）的病证，2022年考试指南未明确说明。